咬合位垂直距离是指
A. 瞳孔连线到口裂间的距离
B. 天然牙列上下牙接触时，鼻底到颏底的距离
C. 上下颌牙槽嵴顶之间的距离
D. 天然牙列位于正中颌位时鼻底至颏底的距离
E. 无牙颌上下颌之间的距离

正确答案：D。天然牙列位于正中颌位时鼻底至颏底的距离

解析：本题考查垂直距离的记录。咬合位垂直距离是指天然牙列位于正中颌位时鼻底至颏底的距离（D对）。垂直距离为天然牙列位于正中颌位时，鼻底至颏底的距离，也就是面部下1/3的距离。确定垂直距离的方法有三种：1.利用息止颌位垂直距离减去息止（牙合）间隙的方法；2.瞳孔至口裂的距离等于垂直距离的方法；3.面部外形观察法：在一般情况下，瞳孔连线到口裂间的距离与垂直距离的数值相等，但并非人人均与鼻底至颏底的距离相等（A错）。天然牙列上下牙接触可能为正中颌位，也可能为后牙牙尖斜面部分接触的正中关系位，还可能为一侧上下牙接触的侧（牙合）颌位，只有天然牙列位于正中颌位时鼻底至颏底的距离才称为垂直距离（B错）。牙列缺失和牙周组织吸收后，上下无牙颌牙槽嵴顶形成的间隙名为颌间距离，此处，有两个着重点，一个是无牙颌（C错），一个是牙槽嵴顶之间（E错）。